正常成年人的肾小球滤过率
A. 100ml/min
B. 125ml/min
C. 250ml/min
D. 1L/min
E. 180L/min

正确答案：B。125ml/min